氯化钠在醋酸可的松混悬型注射液处方中的作用是
A. 渗透压调节剂
B. 抑菌剂
C. 助悬剂
D. 润湿剂
E. 抗氧剂

正确答案：A。渗透压调节剂

解析：本题考查注射剂常用的附加剂。醋酸可的松注射液处方分析：醋酸可的松微晶-主药；硫柳汞-抑菌剂（B错）；氯化钠-渗透压调节剂（A对）；聚山梨酯80-润湿剂（D错）；羧甲基纤维素钠-助悬剂（C错）；注射用水-溶剂。此处方中无抗氧剂（E错）。